医学道德自我表现评价的方式是
A. 社会舆论
B. 内心信念
C. 医德传统
D. 实行奖励
E. 省悟

正确答案：B。内心信念

解析：医学道德评价方式包括社会舆论、传统习俗和内心信念。医务人员的内心信念是指发自内心地对医德原则、规范和理想的正确性和崇高性的笃信，以及由此而产生的实现医德义务的强烈责任感。它通过道德良心发挥自律作用，能促进医务人员自觉地进行善恶评价和行为选择（B对）。社会舆论是指公众对某种社会现象、事件或行为的看法和态度。社会舆论是社会道德评价的主要方式，是一种精神力量，对于敦促医务人员履行医德义务具有特殊的作用（A错）。传统习俗指人们在长期社会生活中逐步形成和沿袭下来的一种稳定的、习以为常的行为倾向。在种种传统习俗中，只有那些涉及患者健康利益、体现医务人员职业道德价值观念的习俗，才是医德评价时应该考虑的（C错）。在我国的医疗卫生系统，除各级医疗卫生组织之外，政府的卫生管理部门还组织对医学道德优良的医务人员开展表彰活动，这类活动包括纳入医疗机构日常管理的表彰活动，还包括在社会特定公共卫生事件发生以后对医疗卫生行业作出特殊贡献的表彰活动。这类表彰活动是社会对高尚医学道德行为的肯定、褒扬、鼓励和宣扬（D错）。实践过程中的内省，是指在进行医学实践活动过程时，省察自己的行为及其背后的观点、态度，是不是与规范相 一致，及时发现自己的错误行为及其支配观念，并加以辩驳、纠正，以及在下一次的实践过程中表现出恰当的行为（E错）。